一次用药可避孕1个月经周期的药物是
A. 左炔诺孕酮片
B. 复方庚酸炔诺酮注射液
C. 去氧孕烯炔雌醇片
D. 米非司酮片
E. 双炔失碳酯肠溶片

正确答案：B。复方庚酸炔诺酮注射液

解析：本题考查避孕药。一次用药可避孕1个月经周期的药物是复方庚酸炔诺酮注射液（B对）。左炔诺孕酮（A错）用作紧急避孕药。去氧孕烯炔雌醇片（C错）用于避孕和月经周期调控。米非司酮片（D错）与前列腺素药物序贯合并使用，可用于终止停经49日内的妊娠。双炔失碳酯肠溶片（E错）为探亲避孕药。